女，31岁。咳嗽、咳脓痰、间断咯血10年。近5天来受凉后咳痰加剧伴咯血。该患者最可能的诊断是
A. 先天性肺囊肿
B. 大叶性肺炎
C. 支气管扩张
D. 肺脓肿
E. 慢性支气管炎

正确答案：C。支气管扩张

解析：患者为青年女性，咳嗽、咳脓痰、间断咯血10年（为支气管扩张的典型表现），受凉后咳痰加剧伴咯血，根据临床症状，考虑为支气管扩张（C对）。先天性肺囊肿（A错）是一种肺部先天性畸形，小的囊肿可无任何症状，仅在X线检查时发现。大叶性肺炎（P46）（B错）常有上呼吸道感染的前驱症状，表现为寒战、高热、咳铁锈色痰。肺脓肿（P58）（D错）主要表现为急性起病，畏寒、高热伴有咳嗽、咳脓臭痰。慢性支气管炎（P20）（E错）主要表现为咳嗽、咳白色黏液性痰、喘息或气急。